“三同时”是指
A. 同时规划、同时设计、同时施工
B. 同时投资、同时开工、同时竣工
C. 同时规划、同时设计、同时开工
D. 同时设计、同时开工、同时竣工
E. 同时设计、同时施工、同时投产

正确答案：E。同时设计、同时施工、同时投产